在进行暴发调查时，首先应该
A. 采取防制措施
B. 构成初步假设
C. 确认暴发是否发生
D. 调查暴发三间分布
E. 核实诊断

正确答案：E。核实诊断

解析：本题考查暴发调查的步骤。当发生突发公共卫生事件时，应采取暴发调查。暴发调查的步骤包括：1.准备和组织；2.核实诊断（E对ABCD错）；3.确定暴发的存在；4.病例定义；5.病例发现与核实；6.描述疾病的三间分布；7.建立假设及验证假设；8.完善现场调查；9.实施控制措施；10.总结报告。